预防肠道传染病的综合措施中，主要措施是
A. 治疗患者
B. 隔离带菌者
C. 切断传播途径
D. 预防接种
E. 接触者预防服药

正确答案：C。切断传播途径

解析：本题考查预防肠道传染病的措施。预防肠道传染病的综合措施中，主要措施是切断传播途径（C对ABDE错）。肠道传染病主要通过粪口传播，应对病人排泄物、污水、垃圾、被污染的物品和周围环境等进行消毒处理。